可以成为某些牙源性肿瘤或者囊肿，残留于颌骨中，起源于牙板残余上皮的称为
A. Malassez上皮剩余
B. 外釉上皮
C. 星网状层
D. Serre上皮剩余
E. 上皮根鞘

正确答案：D。Serre上皮剩余

解析：成釉器钟状期末残余的牙板上皮以上皮岛或上皮团的形式存在于颌骨或牙龈中，婴儿时期俗称为“马牙”，可自行脱落。但是在某些刺激因素下可形成牙源性肿瘤或囊肿。此部分上皮被称作Serre上皮剩余。掌握“牙胚的发生及分化”知识点。